在美国，有40个州通过了《死亡权利法案》的时间是
A. 1947年
B. 1957年
C. 1967年
D. 1977年
E. 1987年

正确答案：D。1977年